胆固醇不能转化成
A. 胆汁酸
B. 维生素D₃
C. 睾丸酮
D. 雌二醇
E. 胆红素

正确答案：E。胆红素

解析：胆固醇在体内可转化为胆汁酸（A错）、醛固酮、睾丸酮（C错）、雌二醇（D错）、孕酮及维生素D₃（B错）等。胆汁酸是胆固醇体内代谢的主要去路；睾丸间质细胞以胆固醇为原料合成睾酮（C错）；卵泡内膜细胞及黄体以胆固醇为原料合成雌二醇（D错）及孕酮；胆固醇可在皮肤被氧化为7-脱氢胆固醇，经紫外光照射转变为维生素D₃（B错），但胆固醇不能转化成胆红素（E对）。胆红素主要来自衰老红细胞破坏所释放的血红蛋白的分解。